下列疾病中与牙周炎发病关系密切的是
A. 先天愚型综合征
B. 胃溃疡
C. 心脏病
D. 肾盂肾炎
E. 高血压

正确答案：A。先天愚型综合征

解析：反映全身疾病的牙周炎包括有掌跖角化-牙周破坏综合征、Down综合征（先天愚型）、家族性和周期性白细胞缺乏症、粒细胞缺乏症、白细胞功能异常、糖尿病和艾滋病。掌握“反应全身疾病的牙周炎”知识点。